右心室流入道是
A. 左心室窦部
B. 右心室窦部
C. 动脉圆锥
D. 主动脉前庭
E. 腔静脉窦

正确答案：B。右心室窦部

解析：右心室窦部（B对）为右心室流入道，从右房室口延伸至右心室尖。